患者，男，34岁，因糖尿病酮症酸中毒入院，需静脉给予胰岛素或胰岛素类似物，应选用的药物是
A. 门冬胰岛素
B. 精蛋白锌胰岛素
C. 低精蛋白锌胰岛素
D. 普通胰岛素
E. 地特胰岛素

正确答案：D。普通胰岛素

解析：本题考查普通胰岛素。普通（常规）胰岛素（D对）可用于抢救糖尿病酮症酸中毒和高血糖高渗性昏迷（静脉）。门冬胰岛素（A错）属于速效胰岛素类似物，皮下注射主要控制一餐饭后的高血糖。精蛋白锌胰岛素（B错）无明显作用高峰，用于提供基础胰岛素。低精蛋白锌胰岛素（C错）属于中效制剂，用于提供基础胰岛素。地特胰岛素（E错）属于长效胰岛素，无明显作用高峰，用于提供基础胰岛素。